高血压伴支气管哮喘患者不宜选用的药物是
A. 普萘洛尔
B. 羧甲司坦
C. 福莫特罗
D. 孟鲁司特
E. 氨氯地平

正确答案：A。普萘洛尔

解析：本题考查普萘洛尔。高血压伴支气管哮喘患者不宜选用的药物是普萘洛尔（A对）。由于普萘洛尔的不良反应有支气管痉挛及呼吸困难、充血性心力衰竭等，故支气管哮喘患者以及重度或急性心力衰竭患者禁用普萘洛尔。消化道溃疡活动期患者禁用羧甲司坦（B错）。对福莫特罗或乳糖（其中包含少量牛奶蛋白质）过敏的病人禁用福莫特罗（C错）。对孟鲁司特（D错）中的任何成份过敏者禁用孟鲁司特。氨氯地平（E错）的禁忌有：①对二氢吡啶类药物或本品中任何成分过敏的病人禁用。②严重低血压的病人禁用。③重度主动脉瓣狭窄的病人禁用。